阻滞钙通道，降低自律性的药物是
A. 利多卡因
B. 维拉帕米
C. 奎尼丁
D. 普萘洛尔
E. 胺碘酮

正确答案：B。维拉帕米

解析：本题考查维拉帕米。维拉帕米（B对）为钙通道阻滞剂，能够减慢窦房结的自律性和房室结的传导，有效的终止房室结折返性心动过速。利多卡因（A错）为钠通道阻滞剂，用于室性心律失常。奎尼丁（C错）为钠通道阻滞剂Ⅰa类抗心律失常药。普萘洛尔（D错）为β受体阻断剂，可减轻由β受体介导的心律失常。胺碘酮（E错）为Ⅲ类抗心律失常药，能够延长动作电位时程，主要用于治疗室上性和室性心律失常。